《中国药典》规定要做重金属检测的药材是
A. 地龙
B. 僵蚕
C. 龟甲
D. 蛤蚧
E. 蕲蛇

正确答案：A。地龙

解析：本题考查的是地龙的检查。《中国药典》规定要做重金属检测的药材是地龙（A对）。重金属的检查：重金属是指在实验条件下能与硫代乙酰胺或硫化钠作用显色的金属杂质，如铅、镉、汞、铜等。测定重金属总量用硫代乙酰胺或硫化钠显色反应比色法，测定铅、镉、汞、铜重金属元素采用原子吸收光谱法和电感耦合等离子体质谱法。《中国药典》一部规定，甘草、黄芪、丹参、白芍、西洋参、金银花等含铅不得过5mg/kg，镉不得过0.3mg/kg，汞不得过0.2mg/kg，铜不得过20mg/kg。矿物药如石膏、芒硝含重金属不得过10mg/kg，玄明粉不得过20mg/kg；动物药如地龙含重金属不得过30mg/kg；植物药如银杏叶、黄芩、连翘的提取物含重金属不得过20mg/kg等。僵蚕（B错）【检查】杂质不得过3.0%，总灰分不得过7.0%，酸不溶性灰分不得过2.0%，水分不得过13.0%。黄曲霉毒素本品每1000g含黄曲霉毒素B₁不得过5μg，含黄曲霉毒素G₂、黄曲霉毒素G₁、黄曲霉毒素B₂和黄曲霉素B₁的总量不得过10μg。